次阳性。入院后3天突感呼吸困难、胸痛，咯血多次。可能性最大的诊断是
A. 室间隔缺损合并急性心衰
B. 感染性心内膜炎合并急性肺栓塞
C. 感染性心内膜炎合并肺部感染
D. 室间隔缺损合并肺部感染
E. 室间隔缺损合并支气管扩张症

正确答案：B。感染性心内膜炎合并急性肺栓塞

解析：中年女性患者，持续发热2周，有先天性心脏病病史。入院查体：贫血貌，胸骨左缘3-4肋间4/6级粗糙收缩期杂音伴震颤，脾肋下2cm，血培养2次阳性（提示感染性心内膜炎）。入院后3天突感呼吸困难、胸痛，咯血多次（提示急性肺栓塞）。综合患者的症状、体征，可能性最大的诊断是感染性心内膜炎合并急性肺栓塞（B对）。急性心衰（A错）咳粉红色泡沫状痰，多无脾大的表现。肺部感染（CD错）多无心音异常和脾大的表现。室间隔缺损（ADE错）多无咯血和脾大的表现。支气管扩张症（E错）的主要症状为持续或反复的咳嗽、咳痰或咳脓痰。